胃食管反流病的主要症状是
A. 反酸
B. 上腹痛
C. 咽异物感
D. 吞咽困难
E. 喛气

正确答案：A。反酸

解析：胃食管反流病的主要症状是反酸（A对）和烧心。咽异物感（C错）属于食管外症状；吞咽困难（D错）见于部分患者，二者均不是胃食管反流病的主要症状。上腹痛（B错）和嗳气（E错）为消化系统疾病的常见症状，不具有特异性。